患儿，10个月。近半个月不思乳食，脘腹胀满，疼痛拒按，呕吐酸馊，烦躁哭吵，大便较干，臭秽，舌淡苔白腻。其诊断是
A. 厌食
B. 腹痛
C. 疳证
D. 积滞
E. 呕吐

正确答案：D。积滞

解析：积滞是指小儿内伤乳食，停聚中焦，积而不化，气滞不行所形成的一种胃肠疾患，故以不思乳食，食而不化，脘腹胀满，嗳气酸腐，大便溏薄或秘结酸臭为临床特征，本病例患儿临床表现与之相符，故诊断为积滞（D对）。厌食（A错）是小儿时期的一种常见病症，临床以较长时期的食欲减退或消失，厌恶进食，食量减少为特征，一般无脘腹胀满、疼痛拒按、大便臭秽等临床表现。该患儿虽有脘腹胀满，疼痛拒按的症状，但实质是由乳食积滞内停，气机阻滞，不通则痛所致，故不诊断为腹痛（B错）。疳证（C错）临床表现以形体消瘦，饮食异常，面黄发枯，精神萎靡或烦躁不安为特征。该患儿虽有呕吐（E错）症状，但实质是由乳食积滞，气机不利，胃失和降所致，为次要症状，故不诊断为呕吐。